含强心苷类成分杠柳毒苷的中药是
A. 柴胡
B. 陈皮
C. 知母
D. 香加皮
E. 合欢皮

正确答案：D。香加皮

解析：本题考查的是香加皮的化学成分。含强心苷类成分杠柳毒苷的中药是香加皮（D对）。香加皮中含有强心苷类化合物为甲型强心苷，其中杠柳毒苷和杠柳次苷为其主要成分。柴胡（A错）中含有的总皂苷为1.6%～3.8%。柴胡中所含皂苷均为三萜皂苷，柴胡皂苷是柴胡的主要有效成分。《中国药典》以柴胡皂苷a和柴胡皂苷d为指标成分对柴胡药材进行含量测定。要求两者的总含量不少于0.30%。陈皮（B错）中除含挥发油外，还含有多种黄酮类化合物，其中橙皮苷多制成甲基橙皮苷供药用，是治疗冠心病药物“脉通”的重要原料之一。《中国药典》以橙皮苷为指标成分对陈皮进行含量测定。要求陈皮中橙皮苷含量不得少于3.5%；广陈皮中橙皮苷含量不得少于2.0%，对广陈皮，另外要求测定川陈皮素和橘皮素的总量，总量不得少于0.42%。知母（C错）中的化学成分主要为甾体皂苷和芒果苷，还含有木脂素、甾醇、鞣质、胆碱等成分。《中国药典》上将知母皂苷BⅡ和芒果苷定为知母药材的质量控制成分，要求知母皂苷BⅡ含量不得少于3.0%，芒果苷的含量不得少于0.7%。饮片指标低于原药材，如蓝知母要求知母皂苷BⅡ含量不得少于2.0%，芒果苷含量不得少于0.40%。合欢皮（E错）极性部分的主要成分是三萜皂苷。《中国药典》以（-）-丁香树脂酚-4-O-β-D-呋喃芹糖基-（1→2）-β-D-吡喃葡萄糖苷为指标成分进行含量测定，要求不得少于0.030%。